下列可引起姿势性脊柱侧凸的是
A. 佝偻病
B. 先天性斜颈
C. 胸膜肥厚
D. —侧腰肌瘫痪
E. 儿童发育期坐或立姿势不良

正确答案：E。儿童发育期坐或立姿势不良

解析：脊柱侧凸分为姿势性侧凸和器质性侧凸。姿势性脊柱侧凸无脊柱结构的异常，早期脊柱的弯曲度多不固定，改变体位可使侧凸得以纠正，引起姿势性脊柱侧凸的原因有：儿童发育期坐或立姿势不良（E对）、一侧下肢明显短于另一侧、椎间盘突出、脊髓灰质炎后遗症等。佝偻病患者呈脊柱后凸（A错）。先天性肌斜颈（B错）、胸膜肥厚（C错）、一侧腰肌瘫痪（D错）为器质性脊柱侧凸，改变体位不能使侧凸纠正。